牙骨质龋细菌入侵的主要通道是
A. 牙骨质层板
B. 穿通纤维
C. 生长线
D. 成牙骨质细胞突起
E. 牙骨质细胞陷窝

正确答案：B。穿通纤维

解析：牙骨质龋：在病变早期有表层的相对矿化，随病变进一步进展，细菌产生的酸及代谢产物沿穿通纤维向深层进展，继而细菌产生的蛋白溶解酶破坏有机基质。掌握“牙本质，牙骨质龋”知识点。